儿童膳食达到合理营养的具体表现是
A. 各类食物搭配合理
B. 色、香、味俱佳
C. 饮食卫生
D. 平衡膳食
E. 合理烹饪，营养素损失少

正确答案：D。平衡膳食

解析：本题考查儿童营养的需求特点。儿童膳食达到合理营养的具体表现是平衡膳食（D对）。平衡膳食指摄入的各种食品的品种、数量和质量与儿童的需要相平衡。平衡膳食的要求如下：①合理搭配各类食品（A错），以使食物中的热能与各种营养素数量、比例尽可能与儿童的生理需要相一致。②合理加工、烹调，以减少营养素的损失（E错）。③注意食物的色、香、味（B错）等感官性状，以增进儿童的食欲。④注意饮食卫生（C错），保证食物的无毒、无害、无污染和无腐败变质。